对牙髓疾病临床上热诊常用的方法
A. 热牙胶
B. 热水
C. 加热的金属器械
D. 橡皮轮打磨生热法
E. 以上都是

正确答案：A。热牙胶

解析：热测工具：将牙胶棒在酒精灯上加热变软，但不使之冒烟燃烧（约65～70℃）。掌握“牙髓病检查方法及诊断程序”知识点。